在一批霉变的食品中检出大量硝酸盐和仲胺，它们在适宜的条件下可形成
A. 腐胺
B. 亚硝胺
C. 甲胺
D. 组胺
E. 色胺

正确答案：B。亚硝胺